属于开闭口运动的是
A. 闭口运动
B. RCP起始的开口运动
C. MPP起始的开口运动
D. ICP起始的开口运动
E. 以上说法均正确

正确答案：E。以上说法均正确

解析：开闭口运动：①RCP起始的开口运动；②ICP或MPP起始的开口运动；③开口运动的力；④闭口运动；⑤闭口运动的力；⑥开闭口运动正常的标志。掌握“下颌运动的形式、范围及意义”知识点。